某男，48岁。诊断为原发性肝癌，证属瘀毒内结、正虚邪实。予以艾迪注射液100ml+5%葡萄糖注射液250ml静脉滴注，一日1次。药师审核处方的问题是
A. 药证不符
B. 给药方式不当
C. 超剂量使用
D. 溶媒用量不足
E. 溶媒选用不当

正确答案：D。溶媒用量不足

解析：本题考查的是中药注射剂不合理使用例举。某男，48岁。诊断为原发性肝癌，证属瘀毒内结、正虚邪实。予以艾迪注射液100ml+5%葡萄糖注射液250ml静脉滴注，一日1次。药师审核处方的问题是溶媒用量不足（D对）。中药注射剂溶媒用量不足（药物浓度过高）：某男，48岁。原发性肝癌。予以艾迪注射液100ml+5%葡萄糖注射液250ml静脉滴注。用药10分钟，心悸。查体：面色潮红、肿胀，可见散在皮疹，心率70次/分，血压110/70mmHg。立即停止输液，给予苯海拉明注射液20mg肌内注射，30分钟后症状缓解。分析：艾迪注射液说明书［用法用量］注明“成人一次50～100ml，加入0.9%氯化钠注射液或5%～10%葡萄糖注射液400～450ml中静脉滴注”。该例以5%葡萄糖注射液250ml配制溶剂稀释100ml艾迪注射液，溶媒用量明显不足，造成药物浓度过高。中药注射剂浓度与微粒成正比，微粒数随药物浓度而变化。另有研究表明，临床给药过程中药品浓度过大或给药速度过快，均可能导致头晕、疼痛、刺激性皮炎等不良反应的发生。因此，建议临床使用中药注射剂时应严格按说明书推荐剂量使用，切不可随意加大剂量。